青霉素类药物的临床应用
A. 大叶性肺炎
B. 心内膜炎
C. 扁桃体炎
D. 支气管肺炎
E. 以上说法均正确

正确答案：E。以上说法均正确

解析：青霉素类药物的临床应用：①溶血性链球菌引起的蜂窝织炎、丹毒、猩红热、咽炎、扁桃体炎、心内膜炎等；肺炎球菌引起的大叶性肺炎、脓胸、支气管肺炎等；草绿色链球菌引起的心内膜炎。②淋病奈瑟菌所致的生殖道淋病；敏感的金黄色葡萄球菌引起的疖、痈、败血症等；脑膜炎奈瑟菌引起的流行性脑脊髓膜炎；也可用于放线杆菌病、钩端螺旋体病、梅毒、回归热的治疗。③白喉、破伤风、气性坏疽和流产后产气荚膜梭菌所致的败血症的治疗。但因青霉素G对细菌产生的外毒素无效，故必须加用抗毒素血清。掌握“青霉素及头孢菌素类药”知识点。